规划环境影响评价的工作程序不包括的阶段是
A. 规划纲要编制阶段
B. 规划研究阶段
C. 规划编制阶段
D. 规划报批阶段
E. 规划结论阶段

正确答案：E。规划结论阶段

解析：本题考查规划环境影响评价的工作程序。规划环境影响评价是指对规划实施后可能造成的环境影响进行分析、预测和评估，提出预防或者减轻不良环境影响的对策和措施，进行跟踪监测的方法与制度。其工作程序为：1.规划纲要编制阶段（A对）：通过对规划可能涉及内容的分析，收集与规划相关的法律、法规环境政策和产业政策，对规划区域进行现场踏勘，收集有关基础数据，初步调查环境敏感区域的有关情况，识别规划实施的主要环境影响，分析提出规划实施的资源和环境制约因素，反馈给规划编制机关。2.规划研究阶段（B对）：评价可随着规划的不断深人，及时对不同规划方案实施的资源、环境、生态影响进行分析预测和评估，综合论证不同规划方案的合理性，提出优化调整建议，反馈给规划编制机关，供其在不同规划方案的选择中参考。3.规划编制阶段（C对）：应针对环境影响评价推荐的环境可行的规划方案，从战略和政策层面提出环境影响减缓措施。如果规划为未采纳环境影响评价方案，提出环境管理要求，反馈给规划编制机关。如果规划选择的方案资源环境无法承载，可能造成重大不良环境影响且无法提出切实可行的预防或减轻对策和措施，以及对可能产生的不良环境影响的程度或范围尚无法做出科学判断时，应提出放弃规划方案的建议，反馈给规划编制机关。4.规划报批阶段（D对）：在规划上报审批前，应完成规划环境影响报告书的编写与审查，并提交给规划编制机关。规划结论阶段（E错，为本题正确答案）不是规划环境影响评价的工作程序。